关于牙刷下列哪一条是错误的
A. 牙刷毛越软，清洁作用越好
B. 牙刷的刷头大小要合适
C. 尼龙丝牙刷较猪鬃毛牙刷好
D. 牙刷毛太硬容易损伤牙齿
E. 牙刷不用时应刷头朝上放在牙杯中

正确答案：A。牙刷毛越软，清洁作用越好

解析：本题考查牙刷的相关知识点。刷毛越软，清除菌斑效果越差（A错，为本题正确答案）。牙刷刷头的大小应合适（B对），这样才能便于刷头进入难刷的部位。尼龙丝牙刷刷毛可塑性好，不易吸水，易干燥，弹力好，因此在实际应用中，多用尼龙丝牙刷；猪鬃毛牙刷刷毛韧性较强，不建议使用（C对）。刷毛太硬会损伤到牙龈和牙齿（D对），因此应选择刷毛软硬适度的牙刷。牙刷在不用时，应保持清洁和干燥，所以在刷完牙后应将刷头朝上放置于牙杯中（E对）。